临床上可出现差异性青紫（上半身不紫而下半身紫）的先天性心脏病是
A. 法洛四联症
B. 完全性大动脉转位
C. 动脉导管未闭
D. 房间隔缺损
E. 室间隔缺损

正确答案：C。动脉导管未闭

解析：差异性发绀是动脉导管未闭（C对）右向左分流时的典型临床表现。当肺动脉压力超过主动脉时，左向右分流明显减少或停止，肺动脉血逆流入主动脉。由于动脉导管开口位置位于主动脉弓远端，含氧量低的肺动脉血流进入左锁骨下动脉及主动脉降部，造成左上肢轻度青紫，下半身青紫；而头臂干及左颈总动脉位于主动脉弓近端，受肺动脉血逆流影响较小，血氧含量高，左颈总动脉及头臂干分支右颈总动脉和右锁骨下动脉供给的颜面部和右上肢正常。